强心苷治疗房颤的药理基础是
A. 兴奋窦房结
B. 加强心肌收缩力
C. 抑制房室传导，延长房室结的ERP
D. 缩短心房的ERP
E. 减少心输出量

正确答案：C。抑制房室传导，延长房室结的ERP

解析：减慢房室结传导速度：这主要是迷走神经所介导。迷走神经兴奋减慢Ca²+内流，使呈慢反应电活动的房室结的除极减慢，因而其传导速度减慢。减慢传导是强心苷治疗心房颤动时减少心室频率的重要依据（C对）。